长期使用含腌制食品容易造成什么类型的缺氧
A. 血液型缺氧
B. 组织型缺氧
C. 循环型缺氧
D. 乏氧型缺氧
E. 低张型缺氧

正确答案：A。血液型缺氧

解析：腌制食品含有大量的亚硝酸盐，长期食用可引发亚硝酸盐中毒，造成体内出现血红蛋白质和量的异常，易造成血液型缺氧（A对）。组织性缺氧见于线粒体生物氧化，特别是氧化磷酸化等内呼吸功能障碍（B错）。循环性缺氧见于心肺功能衰竭或局部性缺血（C错）。低张性缺氧，又称为乏氧性缺氧，见于空气中氧分压低或气道外呼吸障碍（E错）。